关于脑出血患者的抢救，对于防止加重出血，以下哪项不正确
A. 不宜长途运送
B. 不宜过多搬动
C. 保持大便通畅
D. 不宜用镇静药
E. 不宜将血压降得过低

正确答案：C。保持大便通畅